患者，女，27岁，已婚。近几个月来带下量多、黏稠、色黄，胸闷心烦，纳少便溏，舌淡红、苔黄略腻，脉细。其治法是
A. 清热利湿止带
B. 健脾利湿止带
C. 健脾益气止带
D. 清热解毒止带
E. 补肾健脾止带

正确答案：A。清热利湿止带

解析：题中患者近几个月来带下量多、黏稠、色黄，故诊断为带下过多。带下量多、黏稠、色黄为湿热蕴结于下，损伤任带二脉所致。湿热内盛，阻于中焦，故胸闷心烦，纳少便溏。舌淡红、苔黄略腻，脉细均为湿热之象，故辨为湿热下注证。治法当选清热利湿止带（A对）。健脾利湿止带为脾虚湿盛的治法（B错）。健脾益气止带为带下过多脾虚证的治法（C错）。清热解毒止带为带下过多热毒蕴结证的治法（D错）。补肾健脾止带为脾虚与肾虚同见，用于虚证（E错）。